可以降低釉质行使功能时的剪切力，并且此处的釉质晶体和牙本质晶体混杂排列的结构是
A. 釉质牙骨质界
B. 釉质牙本质界
C. 牙本质牙骨质界
D. 牙颈部
E. 绞釉

正确答案：B。釉质牙本质界

解析：釉质牙本质界（釉牙本质界）处交界的形态和性质可以降低釉质行使功能时所受到的剪切力，电镜观察见釉牙本质界处的釉质晶体和牙本质晶体混杂排列。掌握“牙釉质”知识点。